牙骨质不良结构的影像学表现
A. 日光放射状
B. 膜新骨形成，典型者呈葱皮样改变，邻近髓质骨常有硬化
C. 呈斑点状、虫蚀状、网格状
D. 骨密度减低区，边界模糊不清
E. 高密度，点状或小片状钙化影

正确答案：E。高密度，点状或小片状钙化影

解析：本题考查牙骨质不良结构的影像学表现。牙骨质不良结构的影像学表现为高密度，点状或小片状钙化影（E对）。日光放射状（A错）为骨肉瘤的影像学表现。膜新骨形成，典型者呈葱皮样改变，邻近髓质骨常有硬化（B错）为Garre骨髓炎的影像学表现。呈斑点状、虫蚀状、网格状（C错）为放射性颌骨骨髓炎的影像学表现。骨密度减低区，边界模糊不清（D错）为牙源性中央性颌骨骨髓炎的影像学表现。